男性，24岁。患肝内胆汁郁积性黄疸4个月余，下列哪项检查可能异常
A. 凝血酶原时间
B. 血氨
C. 甲胎蛋白
D. 网织红细胞计数
E. 白细胞计数

正确答案：A。凝血酶原时间